在一定期间内、特定人群中某病新病例出现的频率称为
A. 发病率
B. 罹患率
C. 患病率
D. 续发率
E. 死亡率

正确答案：A。发病率

解析：本题考查发病率。在一定期间内、特定人群中某病新病例出现的频率称为发病率（A对）。（1）发病率表示在一定期间内，一定人群中某病新发生的病例出现的频率。是反映疾病对人群健康影响和描述疾病分布状态的一项测量指标。（2）罹患率（B错）是人群新病例数的指标。该指标和发病率相似，表示较短时间内的疾病流行严重程度。罹患率适用于小范围、短时间内疾病频率的测量。（3）患病率（C错）是指某特定时间内总人口中某病新旧病例之和所占的比例。患病率可按观察时间的不同分为期间患病率和时点患病率两种。对慢性病进行现况调查，最适宜计算的指标为患病率。（4）续发率（D错）亦称二代发病率，是指一个家庭、病房、集体宿舍、托儿所、幼儿园班组中第一个病例发生后，在该病的最短潜伏期到最长潜伏期之间，易感接触者中因受其感染而发病的续发病例占所有易感接触者总数的百分率。（5）死亡率（E错）是指用来衡量一部分种群中，一定规模的种群大小、每单位时间的死亡数目（整体或归因于指定因素），是在种群层面上研究的问题。